王某，48岁，建筑工人，因牙关紧闭、四肢痉挛而入院。8天前，右脚被铁钉扎伤，伤口深，但几日后自愈。5日后，右腿有些麻木和疼痛，咀嚼不便，吞咽困难，最后全身抽摘，四肢痉挛。入院诊断为破伤风，请问下述哪项是最佳治疗原则
A. 注射青霉素
B. 注射破伤风抗毒素和青霉素
C. 注射破伤风抗毒素和白百破疫苗
D. 注射破伤风抗毒素
E. 注射白百破疫苗和青霉素

正确答案：B。注射破伤风抗毒素和青霉素